女56岁，急刹车受伤致髋关节剧痛3小时，查体：右髋关节活动受限，屈曲内收，内旋畸形，右髋关节屈伸活动障碍，最可能的损伤是
A. 髋关节脱位合并股神经损伤
B. 髋关节脱位
C. 髋关节骨折
D. 髋关节脱位合并闭孔神经损伤
E. 髋关节脱位合并坐骨神经损伤

正确答案：B。髋关节脱位

解析：患者中年女性，急刹车受伤致髋关节剧痛3小时（外伤史），查体：右髋关节活动受限，屈曲内收，内旋畸形（髋骨后脱位典型体征），右骰关节屈伸活动障碍。综合患者病史及体征，考虑髋关节脱位，髋关节脱位最容易累及到的神经为坐骨神经，但本题没有坐骨神经损伤表现（B对E错）。髋关节骨折（C错）多见于中、老年人有跌倒受伤史，伤后感髋部疼痛，下肢活动受限，不能站立和行走，应怀疑股骨颈骨折。有时伤后并不立即出现活动障碍，仍能行走，但数天后，髋部疼痛加重，逐渐出现活动后疼痛更重，甚至完全不能行走。